男，28岁，昨日因外伤下前牙松动，触痛明显，无自发痛、夜间痛。检查：右下1松Ⅱ度，叩（+），右下2、左下1松I度，牙石I度。治疗应采取措施，不包括
A. 下前牙调（牙合）
B. 牙髓治疗右下1
C. 牙周基础治疗
D. 固定松牙下前牙
E. 观察右下1牙髓状况

正确答案：B。牙髓治疗右下1

解析：本题考查牙震荡的治疗。男，28岁，昨日因外伤下前牙松动，触痛明显，无自发痛、夜间痛。检查：右下1松Ⅱ度，叩（+），右下2、左下1松I度，牙石I度。治疗应采取措施，不包括牙髓治疗右下1（B错，为本题的正确答案）。右下1松动度较大，且外伤后会有牙髓暂时性感觉丧失的可能，可不必急于做根管治疗。该患者下前牙有松动，下前牙应调（牙合）以减轻患牙的（牙合）力负担（A对），还应固定松动的下前牙（D对）。牙石I度，应积极进行牙周基础治疗（C对），施行洁治术、刮治术以消除菌斑牙石。应注意观察右下1牙髓状况（E对），若牙髓反应正常可不进行处理，若有牙髓坏死迹象时，应及时行根管治疗术。